慢性病的自然史分为几个阶段
A. 3个
B. 4个
C. 5个
D. 6个
E. 7个

正确答案：D。6个